胸腺嘧啶在体内合成时甲基来自
A. N₁₀甲酰四氢叶酸
B. 胆碱
C. N₅，N₁₀甲烯四氢叶酸
D. S腺苷甲硫氨酸
E. 肉碱

正确答案：C。N₅，N₁₀甲烯四氢叶酸